患者，男，60岁，坏死性胰腺炎剖腹探查术术后2年，恢复良好。进食油炸食品后出现轻度腹泻。宜选用的药物是
A. 复方阿嗪米特肠溶片
B. 奥美拉唑肠溶胶囊
C. 蒙脱石散
D. 干酵母片
E. 诺氟沙星胶囊

正确答案：A。复方阿嗪米特肠溶片

解析：本题考查复方阿嗪米特肠溶片。该患者宜选用的药物是复方阿嗪米特肠溶片（A对）。对因胆汁分泌不足或消化酶缺乏而引起的症状，可服用复方阿嗪米特肠溶片(每片含阿嗪米特75mg、胰酶100mg、纤维素酶10mg、二甲硅油50mg）。奥美拉唑肠溶胶囊（B错）用于胃溃疡、十二指肠溃疡、应激性溃疡、反流性食管炎和卓-艾综合征（胃泌素瘤）。蒙脱石散（C错）用于成人及儿童急、慢性腹泻。干酵母片（D错）用于营养不良、消化不良、食欲不振及B族维生素缺乏症。诺氟沙星胶囊（E错）用于敏感菌所致的尿路感染、淋病、前列腺炎、肠道感染和伤寒及其他沙门菌感染。